卡托普利的作用机制与下述哪些有关
A. 减少血管紧张素Ⅱ的生成
B. 减少缓激肽的失活
C. 减少血管紧张素Ⅰ的生成
D. 阻断血管紧张素Ⅱ受体
E. 抑制肾素活性

正确答案：A、B。减少血管紧张素Ⅱ的生成；减少缓激肽的失活